男，56岁。间断发热1个月，进行性少尿、咯血10天，查体：BP165/100mmHg，双肺听诊可闻及湿啰音，双下肢水肿。尿常规：尿蛋白（++）。尿沉渣镜检：RBC40～50/HP。血肌酐455µmmol/L，血尿素18mmol/L，ANA（-），抗中性粒细胞胞浆抗体（+）。B超示双肾增大。该患者肾脏最可能的病理特征是
A. 肾小球纤维化、玻璃样变
B. 新月体形成
C. 弥漫性GBM增厚，钉突形成
D. 系膜局灶性节段性增宽或弥漫性增宽
E. 系膜局灶性节段性硬化、玻璃样变

正确答案：B。新月体形成

解析：患者中年男性，间断发热1个月（半数急进性肾小球肾炎病人有前驱上呼吸道感染病史），咳血（III型常有系统性血管炎表现）伴进行性少尿10天，血Cr455μmol/L（正常值44～133μmol/L），BUN18.5mmol/L（正常值2.86～7.14mmol/L），提示患者肾功能不全，B 超示双肾增大，患者抗中性粒细胞胞浆抗体阳性，则患者最可能的诊断是急进性肾小球肾炎Ⅲ型。急进性肾小球肾炎病理类型为新月体肾炎（B对）。弥漫性GBM增厚，钉突形成（C错）为膜性肾病的病理表现（P472）。